患者，男，55岁，间歇性胃痛发作5年，近2个月发作频繁，无规律，同时体重减轻，大便隐血试验持续阳性。应首先考虑的是
A. 食管癌
B. 胃溃疡穿孔
C. 胃癌
D. 十二指肠溃疡穿孔
E. 瘢痕性幽门梗阻

正确答案：C。胃癌

解析：患者，男，55岁，间歇性胃痛发作5年，近2个月发作频繁，无规律，同时体重减轻，癌症为消耗性疾病。癌肿侵犯肠道引起出血，大便隐血试验持续阳性，诊断为胃癌（C对）。食管癌典型的症状为进行性咽下困难，先是难咽干的食物，继而是半流质食物，最后水和唾液也不能咽下（A错）。胃溃疡穿孔临床表现为突然发生剧烈腹痛，疼痛最初开始于上腹部或穿孔的部位，常呈刀割或烧灼样痛，一般为持续性，疼痛很快扩散至全腹部（B错）。十二指肠溃疡穿孔男性病人较多，典型症状是突发性上腹剧痛，呈刀割样，可放射至肩部，很快扩散至全腹。病人常出现面色苍白、冷汗、肢体发冷、脉细等休克症状，伴恶心、呕吐。由于继发细菌性腹膜炎，腹痛可加重。体征：病人呈强迫体位，呼吸表浅，常有高热。全腹压痛，反跳痛，以上腹部最明显，呈"板状腹"。叩诊肝浊音界缩小或消失，可有移动性浊音。听诊肠鸣音消失或明显减弱（D错）。瘢痕性幽门梗阻临床表现为上腹部疼痛、肿胀、沉重感加剧，频发呕吐，并且呕吐液中不含胆汁，上腹部形成胃型蠕动波，并伴有液体震荡音，营养不良、贫血，皮肤干燥等症状则应考虑是否为瘢痕性幽门梗阻（E错）。